房室结位于
A. 冠状窦与右房室口的心外膜深面
B. 冠状窦与右房室口之间的心内膜深面
C. 冠状窦与左房室口的心内膜深面
D. 冠状窦与左房室口的心外膜深面
E. 以上都不是

正确答案：B。冠状窦与右房室口之间的心内膜深面

解析：冠状窦与右房室口之间的心内膜深面（B对）为房室结，其尖对着膜性室间隔的房室部。